在女性回收右卵巢静脉的是
A. 左肾静脉
B. 右肾静脉
C. 肝静脉
D. 肠系膜下静脉
E. 下腔静脉

正确答案：E。下腔静脉

解析：下腔静脉（E对）在女性回收右卵巢静脉，因卵巢静脉为下腔静脉的脏支。